下列不属于颤动舌临床意义的是
A. 肝风内动
B. 气血两虚
C. 热极阴亏
D. 肝肾阴虚
E. 温病热邪炽盛

正确答案：D。肝肾阴虚

解析：颤动舌是指舌体震颤抖动，不能自主的表现，多由热盛、阳亢、阴亏、血虚等致肝风内动所致；或由气血亏虚，使筋脉失于濡养而无力平稳伸展舌体所致；或因热极阴亏而动风、肝阳化风等，皆可出现舌颤动（D错，为本题正确答案）。